除另有规定外，饮片水分含量宜控制的范围是
A. 1%～3%
B. 4%～5%
C. 7%～13%
D. 15%～18%
E. 20%～25%

正确答案：C。7%～13%

解析：本题考查的是炮制饮片含水量。除另有规定外，饮片水分含量宜控制的范围是7%～13%（C对）。饮片的水分测定：中药中含有过量的水分，最容易造成中药霉烂变质，使有效成分分解，且相对减少了实际用量而影响治疗效果，因此，控制中药中的水分含量对保证中药质量有密切关系。《中国药典》对大多数药材和饮片规定了水分的限量，如人参不得过12.0%，红花不得过13.0%。有些饮片是原药材经过加热炮制而来，水分会相应减少。《中国药典》中规定：王不留行不得过12.0%，炒王不留行不得过10.0%；阿胶不得过15.0%，阿胶珠不得过10.0%。按炮制方法及各饮片的具体性状，一般饮片的水分含量宜控制在7%～13%。各类饮片的含水量，《中药饮片质量标准通则（试行）》中规定：蜜炙品不得过15%（D错）；酒炙品、醋炙品、盐炙品、姜汁炙品、米泔水炙品、蒸制品、煮制品、发芽制品、发酵制品均不得过13%；烫制后醋淬制品不得过10%。